男，55岁。出车祸后6小时。6小时来未排尿，导尿管导出黄色尿液50ml。查体：T36.5℃，P140次/分，R28次/分，BP65/50mmHg，意识模糊，双肺呼吸音清，未闻及干湿性啰音，心律齐，腹部膨隆，四肢冰冷。最可能的诊断为
A. 轻度休克，神经源性休克
B. 重度休克，神经源性休克
C. 重度休克，低血容量性休克
D. 中度休克，低血容量性休克
E. 中度休克，神经源性休克

正确答案：C。重度休克，低血容量性休克

解析：55岁中年男性车祸后6小时（车祸引起脏器损伤出血时可造成失血性休克）入院。6小时来未排尿，导致导尿管到处黄色尿液50ml（少尿）。查体：T36.5℃，P140次/分（正常值为（60～100）次/分）（脉速），R28次/分（正常值为（12～20）次/分），BP65/50mmHg（正常值为90～120/60～80mmHg，收缩压70mmHg以下提示重度休克），意识模糊，双肺呼吸音清，未闻及干湿性啰音，心律齐，腹部膨隆，四肢冰冷（为重度休克的表现），根据患者病史、症状体征和实验室检查，可考虑诊断为重度休克，低血容量性休克（C对），因车祸引起脏器出血所致。低血容量性休克分为轻度、中度和重度。轻度休克（A错）表现为：神志清楚，伴有痛苦表情，精神紧张、兴奋或烦躁不安，口渴，皮肤苍白、四肢发凉，收缩压正常或稍升高。中度休克（DE错）表现为：患者神志尚清楚，表情淡漠，很口渴、四肢发冷、苍白，收缩压70mmHg～90mmHg。重度休克表现为：患者意识模糊，甚至昏迷，极度口渴，四肢厥冷、皮肤显著苍白、肢端青紫，收缩压﹤70mmHg，尿少甚至无尿。该患者临床表现及体征均符合重度休克标准，故诊断为重度低血容量性休克。神经源性休克（ABE错）是因神经系统功能障碍或损伤导致周围血管的收缩舒张功能障碍，如脊髓损伤引起的休克。